以下对非参数检验的描述哪一项是错误的
A. 不依赖于总体的分布类型
B. 数据的两端若有不确定数值也可使用
C. 检验效率低于参数检验
D. 犯第Ⅱ类错误的概率小于参数检验
E. 用于分布间的比较

正确答案：D。犯第Ⅱ类错误的概率小于参数检验